最应具备公正廉洁医德素质的是
A. 医院后勤保障人员
B. 医疗资源的管理和分配者
C. 妇产科医师
D. 内科医师
E. 临床护士

正确答案：B。医疗资源的管理和分配者